糖尿病患者尿量增多的原因是
A. 饮水过多
B. 肾小球滤过率增高
C. 肾小管重吸收氯化钠量减少
D. 小管液溶质浓度过高
E. 交感神经紧张度降低

正确答案：D。小管液溶质浓度过高

解析：糖尿病患者尿量增多的原因是渗透性利尿，即由于血糖浓度升高而使超滤液中的葡萄糖量超过近端小管对糖的最大转运率，造成小管液溶质浓度升高（D对），渗透压升高，使小管内外渗透压梯度减小，从而使水和NaCl的重吸收减少，尿量增加。